日本血吸虫的感染方式是
A. 喝生水
B. 接触疫水经皮肤感染
C. 生食或半生食水生植物
D. 生食或半生食溪蟹、蝲蛄
E. 生食或半生食淡水鱼、虾

正确答案：B。接触疫水经皮肤感染